为缩小咽腔、增进腭咽闭合，目前最常用的手术方法为
A. 传统兰氏术
B. Millarcl岛状瓣术
C. 咽后壁组织瓣转移术
D. 腭帆提肌重建术
E. 单瓣后推术

正确答案：C。咽后壁组织瓣转移术

解析：本题考查腭裂的手术方法。腭裂整复术大致可分为两大类手术：一类手术方法是以封闭裂隙、保持和延伸软腭长度、恢复软腭生理功能为主的腭成形术；另一类手术是缩小咽腔、增进腭咽闭合为主的咽成形术。咽成形术是指对腭咽闭合不全进行缩小腭咽腔、增进腭咽闭合之目的而施行的各类手术的总称。咽后壁组织瓣转移术（C对）是目前咽成形术中最常用的手术方法。传统兰氏术（A错）、Millarcl岛状瓣术（B错）、腭帆提肌重建术（D错）、单瓣后推术（E错）都属于腭成形术的手术方法。